釉牙本质界最先形成的釉质，看不到釉柱结构
A. 无釉柱釉质
B. 釉板
C. 釉索
D. 釉龛
E. 釉结

正确答案：A。无釉柱釉质

解析：本题考查无釉柱牙釉质。釉牙本质界最先形成的釉质，看不到釉柱结构为无釉柱釉质（A对），多数乳牙及恒牙表层也有无釉柱釉质，约20～100μm厚。釉板是片状、贯穿整个釉质厚度的结构缺陷，自釉质表面延伸至釉质不同的深度，可达釉牙本质界，在磨片中观察呈裂隙状结构（B错）。釉索为从釉结节处起始的一条从内釉上皮延伸至外釉上皮的条索结构（C错）。釉龛为帽状期片状的牙板向内凹陷形成的充满结缔组织的腔隙（D错）。釉结为帽状期牙胚内，内釉上皮中央的簇状的未分化上皮细胞（E错）。